可以全面描述正态分布资料特征的两个指标是
A. 均数和中位数
B. 均数和标准差
C. 均数和极差
D. 中位数和方差
E. 几何均数和标准差

正确答案：B。均数和标准差

解析：可以全面描述正态分布资料特征的两个指标是均数和标准差（B对）。正态分布完全由两个参数均数（μ）和标准差（σ）决定，μ是位置参数，描述正态分布的平均水平，决定着正态曲线在X轴上的位置；σ是形状参数，描述正态分布的变异程度，决定着正态曲线的分布形状。